男，70岁。乏力、纳差2个月。近一个月睡眠不佳。查体：T36.5℃，P80次/分，R18次/分，BP120/80mmHg。巩膜黄染。腹软，肝肋下未触及，脾肋下2cm，无压痛。实验室检查：ALT105U/L，Alb29g/L，HBV-DNA3.15×10⁶拷贝/ml。腹部B超：脾脏轻度肿大，肝脏边缘不光滑，实质回声不均匀，腹腔中等量积液。目前不宜给予的治疗药物是
A. 水飞蓟宾
B. 甘草酸二铵
C. 地西泮
D. 多烯磷酸脂酰胆碱
E. 恩替卡韦

正确答案：C。地西泮

解析：老年男性患者，乏力、纳差，巩膜黄染，脾大（肋下2cm），腹水（腹腔中等量积液），ALT105U/L（轻度升高，肝损伤），Alb29g/L（低清蛋白血症），HBV-DNA3.15×10⁶拷贝/ml（乙肝病毒感染）。B超示肝脏边缘不光滑，实质回声不均匀。怀疑诊断为肝硬化。可以给予保护肝细胞的药物，如多烯磷脂酰胆碱（D对）、水飞蓟宾（A对）、还原型谷胱甘肽及甘草酸二铵（B对），也可给予抗乙肝病毒药物，如恩替卡韦（E对）。而地西泮（C错，为本题正确答案）属于镇静催眠药。